以下关于腭肌的组成中，由发自三叉神经的运动纤维支配的是
A. 腭帆提肌
B. 腭帆张肌
C. 腭咽肌
D. 腭垂肌
E. 腭舌肌

正确答案：B。腭帆张肌

解析：腭肌的运动除了腭帆张肌外，均有副神经的颅根经迷走神经咽支支配。腭帆张肌则由发自三叉神经的运动纤维支配。掌握“表情肌、舌腭肌”知识点。